下列关于津枯血燥形成原因的叙述，错误的是
A. 高热伤津
B. 烧伤耗津
C. 失血脱液
D. 痰瘀阻津
E. 阴虚劳热

正确答案：D。痰瘀阻津

解析：本题考查津枯血燥的形成原因，属理解记忆内容。高热伤津（A对），或烧伤引起津液损耗（B对），或阴虚痨热，津液暗耗（E对）均会导致津枯血燥。失血脱液也是津液亏乏枯竭的直接原因，可以导致血燥虚热内生或血燥生风（C对）。痰瘀阻津没有津液的亏乏，不会导致血燥虚热内生或血燥生风（D错，为本题正确答案）。